胸导管最常见的注入部位是
A. 左头臂静脉
B. 左锁骨下静脉
C. 左静脉角
D. 左颈外静脉
E. 左颈内静脉

正确答案：C。左静脉角

解析：胸导管收集左颈干、左锁骨下干、左支气管纵隔干、左右腰干和肠干注入左静脉角（C对）。